“起于中焦，下络大肠”的经脉是
A. 足阳明胃经
B. 足太阴脾经
C. 手少阴心经
D. 手阳明大肠经
E. 手太阴肺经

正确答案：E。手太阴肺经

解析：手太阴肺经起于中焦，下络大肠经脉（E对）。足阳明胃经，起于鼻，交頞中（A错）。足太阴脾经，起于大指之端，循指内侧白肉际（B错）。手少阴心经，起于心中，出属心系，下膈，络小肠（C错）。手阳明大肠经，起于大指次指之端，循指上廉（D错）。